可以导致再生障碍性贫血
A. 青霉素
B. 链霉素
C. A和B均是
D. A和B均不是

正确答案：D。A和B均不是

解析：本题考查青霉素和链霉素的不良反应。青霉素用药后可发生严重的过敏反应，不会导致再生障碍性贫血。链霉素属于氨基糖苷类药物，常见的不良反应是耳毒性，不会导致再生性贫血（D对）。